药品监督管理的主要内容是
A. 药品
B. 药事组织
C. 执业药师
D. 药品、药事组织
E. 药品、药事组织、执业药师

正确答案：E。药品、药事组织、执业药师